乳牙FC断髓术中，甲醛甲酚对牙髓组织的作用是
A. 促进牙髓组织钙化
B. 促进牙髓组织的修复
C. 保护牙髓免受细菌感染
D. 引起牙髓血运障碍而使牙髓坏死
E. 在牙髓断面接触区产生凝固性坏死

正确答案：E。在牙髓断面接触区产生凝固性坏死

解析：本题考查乳牙牙髓切断术药物。干髓术又称失活牙髓切断术或FC（甲醛甲酚）断髓术，是用药物FC使牙髓失活，切除冠髓，将干髓剂盖于根髓断面，通过干髓剂的作用，在牙髓断面接触区产生凝固性坏死（E对）,使根髓干燥、硬化、固定，成为无菌干化组织的治疗方法，可用于乳磨牙牙髓炎的治疗。在干髓术中，使用甲醛甲酚是要使根髓干化，而不是促进牙髓组织钙化（A错）。促进牙髓组织修复（B错）的制剂是氢氧化钙制剂或MTA制剂及氧化锌丁香油酚粘固剂，且用于未露髓或穿髓孔小且牙髓未感染的病例。牙髓组织通过甲醛甲酚作用后发生干化，牙髓不再受细菌影响，所以甲醛甲酚没有保护牙髓免受细菌感染（C错）的作用。断髓术中，甲醛甲酚对牙髓组织的作用机理是通过接触牙髓使其干化凝固，而不是引起牙髓血运障碍而使其坏死（D错）。